外感病汗出，热退身凉者，表示
A. 表邪入里
B. 阳气衰少
C. 汗出亡阳
D. 真热假寒
E. 邪去正安

正确答案：E。邪去正安

解析：外感病证因治疗及时、护理得当，机体抵抗力增强，驱邪外出，从而汗出，热退身凉者，是邪向外透达的症状，表明邪有出路，病情有向愈的趋势（E对）。表邪入里（A错）指先出现表证，因表邪不解，内传入里，致使表证消失而出现里证。阳气衰少（B错）指人体阳气亏损，其温养、推动等功能减退，以畏寒肢冷为主要表现的虚寒证。汗出亡阳证（C错），指人体阳气极度衰微而欲脱，以冷汗、肢厥、面白、脉微等为主要表现的危重证。真热假寒证（D错）是指疾病的本质为热证，却出现某些“寒象”的表现，又称“热极似寒”。